FAD中所含的维生素是
A. 维生素B₁
B. 维生素B₂
C. 维生素C
D. 泛酸
E. 维生素PP

正确答案：B。维生素B₂

解析：辅酶FAD（黄素腺嘌呤二核苷酸）和FMN（黄素单核苷酸）中所含的维生素是维生素B₂（B对）；维生素B₁（A错）是辅酶TPP（焦磷酸硫胺素）中所含的维生素；维生素C（C错）本身是一种辅酶；泛酸（D错）是辅酶CoA（辅酶A）中所含的维生素；维生素PP（E错）是辅酶是NAD⁺（烟酰胺腺嘌呤二核苷酸）和NADP⁺（烟酰胺腺嘌呤二核苷酸磷酸）中所含的维生素。